空肠、回肠淋巴结的输出管注入
A. 腹腔淋巴结
B. 肠系膜上淋巴结
C. 肠系膜下淋巴结
D. 腰淋巴结
E. 纵隔上淋巴结

正确答案：B。肠系膜上淋巴结

解析：肠系膜上淋巴结（B对）为空肠、回肠淋巴结、右结肠淋巴结和中结肠淋巴结的输出管注入部位。